理气药的性味多为
A. 苦寒
B. 甘寒
C. 辛苦温
D. 甘苦温
E. 甘辛温

正确答案：C。辛苦温

解析：理气药性味多为辛苦温，辛香行散、味苦能泄、温能通行，故有疏理气机的作用，并可通过调畅气机而达到止痛、散结、降逆之效，如陈皮、青皮（C对）。清热燥湿药的性味多为苦寒（A错），如黄芩、黄连、黄柏。补阴药的性味多为甘寒（B错），如百合、沙参、天冬。部分补气药的性味为甘苦温（D错），如人参、刺五加。性味为甘辛温（E错）的中药分布较为分散，如解表药防风、消食药六神曲、补血药当归。